呼吸性碱中毒对机体的影响主要是
A. 脑血流增加
B. 脑血管收缩
C. 心律失常
D. CO2麻醉
E. 高钾血症

正确答案：B。脑血管收缩

解析：呼吸性碱中毒时，由于低碳酸血症可引起脑血管收缩（B对），由于细胞外液k+进入细胞内，从而产生低钾血症（E错）。脑血流增加（A错）和CO2麻醉（D错）是呼吸性酸中毒的特点。心律失常（D错）是代谢性酸中毒对机体的影响。